不透明瓷的作用，除了
A. 增加瓷层亮度
B. 遮盖金属色
C. 金瓷化学结合
D. 形成金瓷冠基础色调
E. 以上都是

正确答案：A。增加瓷层亮度

解析：本题考查不透明瓷（遮色瓷）的作用。瓷材料可分为遮色瓷、牙本质瓷、牙釉质瓷，釉质瓷可以增加瓷层亮度（A错，为本题正确答案）。遮色瓷即不透明瓷，它可遮盖金属色（B对）、形成金瓷冠基础色调（D对）、是决定金-瓷结合的关键（C对）。